在调查研究中，从总体中按照相同的间隔抽取调查单位进行调查的方法为
A. 分层抽样
B. 系统抽样
C. 整群抽样
D. 单纯随机抽样
E. 普查

正确答案：B。系统抽样

解析：分层抽样是先按照对主要研究指标影响较大的某种特征，将总体分为若干类别，再从每一层内随机抽取一定数量的观察单位组成样本（A错）。系统抽样是将总体的观察单位按顺序分成n个部分，再从第一部分里抽取第k号，依次用相等间隔，从每一部分各抽取一个观察单位组成样本。依据题意“相同间隔”，该抽样方法属于系统抽样（B对）。整群抽样是抽取的群的全部观察单位组成样本（C错）。单纯随机抽样是简单随机抽样，按等概率原则直接从含有N个观察单位的总体中抽取n个观察单位组成样本（D错）。普查是调查目标总体中全部观察对象（D错）。